下列各项，不属导致崩漏常见病因的是
A. 脾虚
B. 肾虚
C. 血虚
D. 血瘀
E. 血热

正确答案：C。血虚

解析：素体脾虚，或劳倦思虑、饮食不节损伤脾气。脾虚血失统摄，甚则虚而下陷，冲任不固，不能制约经血，发为崩漏（A错）。肾气虚则封藏失司，冲任不固，不能制约经血，子宫藏泄失常发为崩漏。（B错）。素体血虚，或久病伤血，营血亏虚，或饮食、劳倦、思虑伤脾，脾虚化源不足，冲任血海不充，可致经血量少，而不可致崩漏（C对）。七情内伤，气滞血瘀；或热灼、寒凝、虚滞致瘀；或经期、产后余血未净而合阴阳，内生瘀血；或崩漏日久，离经之血为瘀。瘀阻冲任、子宫，血不归经而妄行，遂成崩漏。（D错）。素体阳盛血热或阴虚内热；或七情内伤，肝郁化热；或内蕴湿热之邪，热伤冲任，迫血妄行，发为崩漏（E错）。